来访者来询问："我该与谁结婚？""我应该离婚吗？"问题时，心理治疗师应保持
A. 支持原则
B. 反对原则
C. "中立"原则
D. 保密原则
E. 以上说法均正确

正确答案：C。"中立"原则

解析："中立"原则：心理治疗的目的是要帮助病人自我成长，心理治疗师不是"救世主"，因此在心理治疗过程中，不能替病人作任何选择，而应保持某种程度的"中立"。例如当遇到来访者来询问："我该与谁结婚？""我应该离婚吗？"等问题时，要让来访者自己作出决定。掌握“心理治疗原则、主要方法及应用”知识点。